男性，35岁。突发上腹刀割样剧痛2小时来诊。査体：体温37.5℃，脉搏110次/分，血压90/60mmHg，腹平坦，左上腹肌略紧张，局部压痛，全腹有反跳痛，有移动性浊音（+），听诊未闻及肠鸣音。首选的检查是
A. 立位X线腹部透视
B. 腹部B超
C. 腹部CT
D. 急诊胃镜检查
E. 诊断性腹腔灌洗

正确答案：A。立位X线腹部透视

解析：青年男性患者，突发上腹部刀割样疼痛，左上腹肌略紧张，局部压痛，全腹有反跳痛（腹膜刺激征），听诊未闻及肠鸣音、血压尚正常（提示空腔脏器穿孔），结合患者病史和体查，应考虑为消化性溃疡急性穿孔。为明确诊断，首选的检查是立位X线腹部透视（A对）。消化性溃疡穿孔时，大量气体溢入游离腹腔，在立位腹部平片，80%病人可见膈下新月样游离气体，为其特征性表现。该患者一般状况良好，可以行立位X线腹部透视，若发现膈下新月样游离气体，即可确诊。腹部B超（B错）对腹部空腔脏器的显示效果不佳，一般不用。腹部CT（C错）对空腔脏器的显示效果不佳且价格昂贵，一般不作为首选检查。消化性溃疡穿孔，严禁作急诊胃镜检查（D错）。诊断性腹腔灌洗（E错）在溃疡穿孔早期的阳性率较低，故不作为首选检查。